EB病毒抑制宿主的免疫功能可通过
A. 编码IL-6样蛋白
B. 编码IL-8样蛋白
C. 编码IL-10样蛋白
D. 编码IL-12样蛋白
E. 编码IL-16样蛋白

正确答案：C。编码IL-10样蛋白

解析：EB病毒可通过编码IL-10样蛋白抑制宿主的免疫功能。掌握“抗感染免疫”知识点。